牙龈的纤维结缔组织水肿明显，其间有炎症细胞，少量浆细胞，毛细血管增生、扩张、充血，属于以下哪种疾病分型
A. 慢性龈炎-炎症水肿型
B. 剥脱性龈病损-疱型
C. 慢性龈炎-纤维增生型
D. 活动期牙周炎病损
E. 剥脱性龈病损-苔藓型

正确答案：A。慢性龈炎-炎症水肿型

解析：本题考查牙龈疾病。牙龈的纤维结缔组织水肿明显，其间有炎症细胞，少量浆细胞，毛细血管增生、扩张、充血，属于慢性龈炎-炎症水肿型（A对）。慢性龈炎-炎症水肿型：牙龈的纤维结缔组织水肿明显，其间有大量淋巴细胞、中性粒细胞浸润，还可见少量浆细胞，毛细血管增生、扩张、充血。